儿童心理健康的标准为
A. 智力发育正常
B. 情绪良好
C. 心理特点与年龄相符合
D. 行为协调，反应适度
E. 以上说法全对

正确答案：E。以上说法全对

解析：本题考查儿童心理健康的标准。儿童心理健康的标准为：1.智力发育正常；2.情绪稳定协调；3.心理特点与实际年龄相符合；4.行为协调，反应适度（E对ABCD错）；5.良好的人际关系。